患者，男，50岁，左侧上颌第一磨牙残冠拔除，拔牙后向患者交代注意事项时，错误的是
A. 咬住纱卷，半小时后取出
B. 术后1天内唾液中可有少量血丝
C. 拔牙后2小时漱口，保持口腔清洁
D. 宜吃偏冷，偏软的食物
E. 拔牙后避免剧烈运动

正确答案：C。拔牙后2小时漱口，保持口腔清洁

解析：拔牙后24小时不可刷牙漱口。术后应避免进食过热食物及剧烈运动，并注意保持口腔卫生。避免患侧咀嚼，勿用舌舔创口，更不可反复吸吮。掌握“牙拔除术”知识点。